与呼吸运动密切联系两脏器
A. 心肺
B. 肺肝
C. 肾肝
D. 肺脾
E. 肺肾

正确答案：E。肺肾

解析：本题考查的是五脏之间的关系。与呼吸运动密切联系两脏器肺肾（E对）。肺与肾的关系主要表现于津液代谢、呼吸运动、阴液互滋两个方面。心与肺（A错）的关系，主要表现在心主血与肺主气、心主行血与肺主呼吸之间的关系。肺与肝（B错）的关系，主要表现于气机的调节。肝与肾的（C错）的关系，称“肝肾同源”或“乙癸同源”（以天干配五行，肝属乙木，肾属癸水，故称），主要表现于精血同源、藏泄互用及阴阳互资等方面。肺与脾（D错）的关系，主要表现在气的生成和津液的输布代谢两个方面。